哪项检查目的在于观察膝状神经节是否受损
A. 味觉检查
B. 听觉检查
C. 泪液检查
D. 有无面瘫
E. 唾液分泌功能

正确答案：C。泪液检查

解析：本题考查观察膝状神经节是否受损的检查。泪液检查（C对）目的在于观察膝状神经节是否受损，因为膝状神经节支配泪腺的分泌。味觉检查（A错）和唾液分泌功能（E错）检查主要是诊断鼓索与镫骨肌神经节之间是否受损。听觉检查（B错）主要是检查镫骨肌的功能状态，听觉改变说明镫骨肌与膝状神经节之间受损。有无面瘫（D错）可判断面神经是否受损，若只表现为面瘫，则说明是茎乳孔以外的面神经受损。